Ⅰ型超敏反应的防治原则查明变应原最常见方法是
A. 变应原药物试验
B. 变应原皮肤试验
C. 变应原感觉试验
D. 变应原敏感试验
E. 以上说法均正确

正确答案：B。变应原皮肤试验

解析：查明变应原最常见方法是变应原皮肤试验。具体做法是将0.1ml稀释的可疑变应原（如青霉素25U/ml、抗毒素血清1:100、尘螨1:100000、花粉1:10000）在受试者前臂内侧做皮内注射，15～20分钟后观察。若局部皮肤出现红晕，风团直径＞1cm为皮试阳性。掌握“概述及Ⅰ型超敏反应”知识点。